女，35岁。颈前包块8年，心慌、气短、怕热、多汗半年。查体：P110次/分，BP160/70mmHg，无突眼，甲状腺触及多个结节，中等硬度，表面光滑，随吞咽可上下移动。实验室检查：T₃、T₄增高，TSH降低，TPOAb为阴性。最可能的诊断是
A. 慢性淋巴细胞性甲状腺炎
B. 结节性甲状腺肿继发甲亢
C. 甲状腺自主功能腺癌
D. 单纯性甲状腺肿
E. 原发性甲状腺功能亢进症

正确答案：B。结节性甲状腺肿继发甲亢

解析：患者中年女性。颈前包块8年，心慌、气短、怕热、多汗半年（先有甲状腺结节多年，再出现高代谢症状）。查体：P110次/分（脉快，正常值60～100次/分），BP160/70mmHg（收缩压增高，脉压增大，正常值收缩压为90～120mmHg，舒张压为60～80mmHg，脉压30～50mmHg），无突眼，甲状腺触及多个结节，中等硬度，表面光滑，随吞咽可上下移动（结节性甲状腺肿）。实验室检查：T₃、T₄增高，TSH降低（甲状腺肿大+高代谢症状+T₃、T₄增高，TSH降低即可诊断甲状腺功能亢进症（内科学P684），TPOAb为阴性。综上，最可能的诊断是结节性甲状腺肿继发甲亢（B对）。慢性淋巴细胞性甲状腺炎（A错）是一种自身免疫性疾病，血清中可检出甲状腺过氧化物酶抗体（TPOAb）和甲状腺球蛋白抗体(TgAb）等多种抗体（该患者TPOAb为阴性），多为无痛性弥漫性甲状腺肿，对称，质硬，表面光滑，多伴甲状腺功能减退，基础代谢率低（与该患者症状、体征不符）（P231）。甲状腺自主功能腺癌（C错），表现为甲状腺内有单或多个自主性高功能结节，无突眼，结节周围的甲状腺组织呈萎缩改变（P228）。单纯性甲状腺肿（D错）主要体征为甲状腺呈对称、弥漫性肿大（该患者甲状腺触及多个结节），腺体表面光滑，质地柔软，随吞咽上下移动甲状腺不同程度的肿大和肿大结节对周围器官引起的压迫症状是本病主要的临床表现（P226）。原发性甲状腺功能亢进症（E错）是指在甲状腺肿大的同时，出现功能亢进症状，表现为腺体弥漫性、两侧对称肿大，常伴有眼球突出，故又称“突眼性甲状腺肿”（该患者甲状腺为结节性肿大，且无突眼）（P228）。